包裹性积液
A. X线示肋膈角变钝
B. X线示大片状、边缘模糊阴影
C. X线示斑片状、边缘模糊阴影
D. X线示凸面指向肺内呈“D”字征阴影
E. X线示上缘呈向外侧升高的反抛物线阴影

正确答案：D。X线示凸面指向肺内呈“D”字征阴影

解析：包裹性积液是发生在胸膜粘连基础上的局限性胸膜积液，多局限于叶间或肺与隔之间，X线示凸面指向肺内呈“D”字征阴影（D对）。X线示肋膈角变钝（A错）见于少量（300～500ml）的游离性胸腔积液，中等量胸腔积液显示有向外侧、向上的弧形上缘的积液影（E错）。X线示大片状、边缘模糊阴影（B错）多为肺脓肿早期X线表现，也可见于大量胸腔积液。X线示斑片状边缘模糊阴影为大叶性肺炎表现（C错）。